属于中纵隔的结构是
A. 迷走神经
B. 主动脉弓
C. 主动脉胸部
D. 心包及心脏
E. 奇静脉

正确答案：D。心包及心脏

解析：心包及心脏是中纵膈内的结构（D对）。